患者，女，23岁。多种药物过敏史，一周前因上呼吸道感染应用多种药物，具体药名不详，可能有阿司匹林，近2月出现咳嗽，喘憋，端坐呼吸，大汗，两肺布满哮鸣音。应首先考虑的是
A. 急性喉炎
B. 气道异物
C. 慢性喘息性支气管炎
D. 急性左心衰
E. 支气管哮喘

正确答案：E。支气管哮喘

解析：患者对多种药物过敏，一周前在上呼吸道感染应用多种药物，具体药名不详，可能有阿司匹林，近2月出现咳嗽，喘憋，端坐呼吸，大汗，两肺布满哮鸣音，据此可以诊断为支气管哮喘（E对ABCD错）。